中国药典“凡例”规定，防止药品在贮藏过程中风化、吸潮、挥发或异物进入，需采用的贮藏条件是
A. 密闭
B. 密封
C. 严封
D. 熔封
E. 避光

正确答案：B。密封

解析：本题考查中国药典的凡例。中国药典“凡例”规定，防止药品在贮藏过程中风化、吸潮、挥发或异物进入，需采用的贮藏条件是密封（B对）。密封系指用可防止风化、吸潮、挥发或异物进入的容器包装。密闭（A错）系指用可防止尘土及异物进入的容器包装。熔封（D错）或严封（C错）系指用可防止空气、水分的侵入与微生物污染的容器或适宜的材料包装。避光（E错）系指避免日光直射。